采集空气颗粒物时，采样器放置的高度应为
A. 5m
B. 3～5m
C. 3m
D. 1.5～3m
E. 1.5m

正确答案：B。3～5m

解析：本题考查采集空气颗粒物的高度。采集空气颗粒物时，采样器放置的高度应为3～5m（B对ACDE错）。